人群易感性是
A. 由一系列相互联系相继发生的疫源地构成的
B. 传染源及其排出的病原体可以波及到的范围
C. 病原体从受感染的机体排出后，再侵入易感机体前在外环境所经历的全部过程
D. 体内有病原体繁殖且能排出病原体的人和动物
E. 人群作为一个整体对某种传染病易感受的程度

正确答案：E。人群作为一个整体对某种传染病易感受的程度

解析：本题考查人群易感性的概念。人群易感性是指人群作为一个整体对传染病的易感程度（E对ABCD错）。